山药伪品木薯的鉴别特征有
A. 常呈斜片状
B. 切面类白色、粉性
C. 可见淡黄棕色形成层环纹
D. 中央有一细小黄色术心及放射状的黄色小点
E. 味苦

正确答案：A、B、C、D。常呈斜片状；切面类白色、粉性；可见淡黄棕色形成层环纹；中央有一细小黄色术心及放射状的黄色小点

解析：本题考查的是山药伪品木薯的性状鉴别。山药伪品木薯的鉴别特征有常呈斜片状（A对）、切面类白色、粉性（B对）、可见淡黄棕色形成层环纹（C对）、中央有一细小黄色术心及放射状的黄色小点（D对）。木薯的块根伪充山药，本品多切成段或片，外皮多已除去，表面类白色，残留外皮呈棕褐色或黑褐色。断面类白色，靠外侧有一明显黄白色或淡黄棕色的形成层环纹。向内可见淡黄色筋脉点成放射状稀疏散在，中央有一细小黄色木心，有的具裂隙，气微，味淡，嚼之粉性。本品横切面，近木栓层处有石细胞群，薄壁细胞中含草酸钙簇晶。